冬季，某居民在自家较封闭房间内的一盆煤火旁发生昏迷，皮肤黏膜呈樱桃红色，导致该症状最可能的空气污染物为
A. CO
B. CO₂
C. SO₂
D. NOₓ
E. PAH

正确答案：A。CO

解析：本题考查空气污染物。CO是一种无色、无味的有毒气体，它是一种常见的室内空气污染物，可以通过煤火、燃煤、燃油、燃气等燃烧过程产生。CO（A对BCDE错）可以通过呼吸道进入人体，并且容易滞留在血液中，影响血液循环，导致头晕、头痛、恶心、呼吸困难等症状，甚至可能导致昏迷，皮肤呈樱桃红色。